关于微粉知识的叙述，错误的是
A. 休止角小，表明微粉的流动性好
B. 微粉的流速，与其粒度和均匀性相关
C. 轻质粉末堆密度大，重质粉末堆容积大
D. 轻质粉末堆密度小，重质粉末堆容积小
E. 孔隙率系指微粉内孔隙和微粉间空隙所占容积与微粉总容积之比

正确答案：C。轻质粉末堆密度大，重质粉末堆容积大